高效液相色谱法用于药物鉴别的依据是
A. 色谱柱理论板数
B. 色谱峰峰高
C. 色谱峰保留时间
D. 色谱峰分离度
E. 色谱峰面积重复性

正确答案：C。色谱峰保留时间

解析：本题考查高效液相色谱法。高效液相色谱法用于药物鉴别的依据是色谱峰保留时间（C对）。用于鉴别的色谱法主要是高效液相色谱法（HPLC），以含量测定项下记录的色谱图中待测成分色谱峰的保留时间（tR）（C对）作为鉴别依据。色谱柱的理论板数（n）（A错）用于评价色谱柱的分离效能。高效液相色谱法在检查项中的应用：杂质限量用峰面积或峰高计算。峰面积（E错）是指组分色谱峰与基线围成的区域的面积，单位通常为毫伏·秒（mV·s）；峰高（B错）是指组分色谱峰顶点至时间轴的垂直距离称为峰高，单位通常为毫伏（mV）。色谱峰面积或峰高主要用于组分的含量测定指标。分离度（D错）又称分辨率，为了判断分离物质对色谱柱在色谱柱中的分离情况，常用分离度作为柱的总分离效能指标，用R表示。